“前有悬崖后有追兵”这种动机冲突是
A. 双趋冲突
B. 双避冲突
C. 趋避冲突
D. 双重趋避冲突
E. 双趋双避冲突

正确答案：B。双避冲突

解析：动机冲突有四种基本形式：双驱冲突、双避冲突、趋避冲突、双重趋避式冲突。双趋冲突是两个目标具有相同的吸引力，引起同样强度的动机，但由于受条件等因素的限制，无法同时实现，二者必择其一，即所谓“鱼和熊掌不可兼得”（A错）。双避冲突指一个人同时受到两种事物的威胁，产生同等强度的逃避动机，但迫于情势，必须接受其中一个，才能避开另一个，处于左右为难，进退维谷的紧张状态。所谓“前有狼，后有虎”的矛盾冲突（B对）。趋避冲突指一个人对同一事物同时产生两种动机，即向往得到它，同时又想拒绝和避开它（C错）。双重趋避式冲突指多个目标，每个目标对自己都有利也都有弊，反复权衡拿不定主意所产生的冲突（D错）。